子宫肌瘤红色变常发生在
A. 青春期
B. 生育期
C. 妊娠期
D. 围绝经期
E. 绝经后期

正确答案：C。妊娠期

解析：子宫肌瘤发生红色样变常见于妊娠期（C对）或产褥期，其发生机制不清，可能与肌瘤内小血管退行性变使血栓、血红蛋白渗入肌瘤内有关。